进行DNA复制实验时，保留全部DNA复制体系成分，但以DNA聚合酶II代替DNA连接酶，试分析可能会出现什么后果
A. DNA高度缠绕，无法作为模板
B. DNA被分解成无数片段
C. 无RNA引物，复制无法进行
D. 随从链的复制无法完成
E. 冈崎片段生成过量

正确答案：D。随从链的复制无法完成